各型高脂蛋白血症中不增高的脂蛋白是
A. CM
B. VLDL
C. HDL
D. IDL
E. LDL

正确答案：C。HDL

解析：血浆脂质水平异常升高，超过正常范围上限称为高脂血症，传统方法将高脂蛋白血症分为六型：Ⅰ型高脂蛋白血症患者血浆脂蛋白变化为CM（乳糜微粒）（A错）升高，Ⅱ型高脂蛋白血症患者血浆脂蛋白变化为LDL（低密度脂蛋白）（E错）升高，Ⅲ型高脂蛋白血症患者血浆脂蛋白变化为IDL（中间密度脂蛋白）（D错）升高，Ⅳ型高脂蛋白血症患者血浆脂蛋白变化为VLDL（极低密度脂蛋白）（B错）升高，Ⅴ型高脂蛋白血症患者血浆脂蛋白变化为VLDL（极低密度脂蛋白）（B错）及CM（乳糜微粒）（A错）同时升高。各型高脂蛋白血症中不增高的脂蛋白是HDL（高密度脂蛋白）（C对），它可将肝外组织胆固醇转运到肝，转化为胆汁酸排出，从而降低血浆脂蛋白水平，具有抗动脉粥样硬化的作用。